哮病的基本病机是
A. 痰阻气道，肺失宣降
B. 卫气不和，肺失宣降
C. 邪热蕴肺，热壅血瘀
D. 肺失宣肃，肺气上逆
E. 脾肾气虚，气失摄纳

正确答案：A。痰阻气道，肺失宣降

解析：哮喘是因宿痰内伏于肺，复受外邪、饮食、情志、劳倦等诱动内伏之宿痰，致痰阻气道，肺气上逆（A对）而发。哮病的病理因素是痰，其基本病机是外邪侵袭，触动“伏痰”，痰阻气道，肺气上逆。